治疗厥阴头痛，应选取的配穴是
A. 印堂，攒竹，合谷
B. 率谷，外关，足临泣
C. 天柱，后溪，申脉
D. 太冲，内关，四神聪
E. 血海，膈腧，内关

正确答案：D。太冲，内关，四神聪

解析：内关、太冲属于厥阴头痛主穴，四神聪位于头部，属于近治作用，三穴合用符合题干治疗厥阴头痛的要求（D对）。ABCE选项中均不是厥阴经头痛的主穴（ABCE错）。